关于（牙合）创伤下列哪一项是正确的
A. 单纯（牙合）创伤会加重牙周炎症
B. 单纯（牙合）创伤会造成骨下袋
C. 治疗牙周炎消除（牙合）创伤是第一位的
D. （牙合）创伤会增加牙的松动度，所以动度增加是诊断（牙合）创伤的唯一指征
E. 自限性牙松动，没有炎症时不造成牙周组织破坏

正确答案：E。自限性牙松动，没有炎症时不造成牙周组织破坏

解析：本题考查（牙合）创伤。关于（牙合）创伤正确的是自限性牙松动，没有炎症时不造成牙周组织破坏（E对）。归纳起来，目前关于（牙合）创伤对牙周组织作用的认识如下：①单纯、短期的（牙合）创伤不会引起牙周袋（B错），也不会引起或加重牙龈的炎症（A错）；②（牙合）创伤会增加牙的动度，但动度增加并不一定是诊断创伤的唯一指征（D错），因为牙周膜增宽和牙松动可能是以往（牙合）创伤的结果；③当长期的（牙合）创伤伴随严重的牙周炎或明显的局部刺激因素时，它会加重牙周袋和牙槽骨吸收，这种加重作用的真正机制尚不明了；④自限性牙松动在没有牙龈炎症的情况下，不造成牙周组织的破坏。在牙周炎的治疗中，消除炎症是第一位的（C错）；在正畸治疗前必须先治疗已有的牙龈炎症。